下列对牙龈纤维瘤病临床表现描述不正确的是
A. 本病主要在成人时发病，幼儿时候不发病
B. 以上颌磨牙腭侧最为严重
C. 牙齿常因增生的牙龈挤压而发生移位
D. 增生牙龈的颜色正常
E. 由于牙龈的增厚，有时出现牙齿萌出困难

正确答案：A。本病主要在成人时发病，幼儿时候不发病

解析：牙龈纤维瘤病临床表现：①本病可在幼儿时就发病，最早可发生在乳牙萌出后，一般开始于恒牙萌出之后。②牙龈广泛地逐渐增生，可累及全口的牙龈缘、龈乳头和附着龈，甚至达膜龈联合处，以上颌磨牙腭侧最为严重。增生的牙龈可覆盖部分或整个牙冠，以致妨碍咀嚼。增生牙龈的颜色正常，组织坚韧，表面光滑，有时也呈颗粒状或小结节状，点彩明显，不易出血。③牙齿常因增生的牙龈挤压而发生移位。④由于牙龈的增厚，有时出现牙齿萌出困难。掌握“牙龈纤维瘤病”知识点。